属于红细胞破坏过多的贫血是
A. 巨幼细胞性贫血
B. 骨髓病性贫血
C. 铁粒幼细胞性贫血
D. 珠蛋白生成障碍性贫血
E. 慢性病性贫血

正确答案：D。珠蛋白生成障碍性贫血

解析：红细胞破坏过多的贫血即溶血性贫血，溶血性贫血常见的病因有：遗传性球形/椭圆形细胞增多症、阵发性睡眠性血红蛋白尿、蚕豆病、珠蛋白生成障碍性贫血（D对）、免疫性溶血性贫血等。巨幼细胞性贫血（P544）（A错）是由于叶酸或维生素B₁₂缺乏导致DNA合成障碍而引起的贫血；骨髓病性贫血（B错）是由于骨髓基质细胞及造血微环境受损引起的贫血；铁粒幼细胞性贫血（P543）（C错）、慢性病性贫血（P543）（E错）是由于铁利用障碍引起的贫血。巨幼细胞性贫血、骨髓病性贫血、铁粒幼细胞性贫血、慢性病性贫血均属于红细胞生成减少性贫血。